一急性化脓性根尖周炎患者进行根管治疗术，复诊时，叩（-），根管预备后封入樟脑酚棉捻，半小时后爆发疼痛，其可能原因为
A. 根管预备时超出根尖孔
B. 根管预备未达工作长度
C. 根管冲洗液刺激
D. 药物半抗原作用引起免疫应答
E. 以上都不是

正确答案：D。药物半抗原作用引起免疫应答

解析：本题考查宿主对细菌感染的反应-免疫反应。一急性化脓性根尖周炎患者进行根管治疗术，复诊时，叩（-），根管预备后封入樟脑酚棉捻，半小时后爆发疼痛，其可能原因为药物半抗原作用引起免疫应答（D对）。樟脑酚具有抗原特性，将其封入根管中可产生药物半抗原作用引起免疫应答，继而引起剧烈疼痛。该患者叩（-），根尖周组织正常，若根管预备时超出根尖孔往往会立即引起疼痛（A错）。根管预备未达工作长度，则不能完全去除根管内的感染物质、彻底消除炎症，但不会短期内爆发剧痛（B错）。根管冲洗液在根管冲洗时，一般不会超出根尖孔，对根尖周组织造成伤害（C错）。